某一高层封闭式办公大楼，终日采用集中式空调系统，近日工作人员诉说呼吸道干燥、鼻塞、头痛、注意力不集中、易疲劳等，但下班后返回家中，上述症状自行消失。此病症最可能是
A. 与建筑物有关的疾病（BRI）
B. 不良建筑综合征（SBS）
C. CO中毒
D. CO₂中毒
E. 流行性感冒

正确答案：B。不良建筑综合征（SBS）

解析：本题考查不良建筑物综合征。不良建筑综合征（SBS）是一种由于建筑物内空气质量差引起的疾病，其症状包括呼吸道干燥、鼻塞、头痛、注意力不集中、易疲劳等，且这些症状会在离开建筑物后自行消失，因此病症最可能是不良建筑综合征（SBS）（B对ACDE错）。